患者，女，50岁。右耳垂下无痛性肿物，缓慢生长6年。触诊肿块界限清，可活动，约4.0cm×4.0cm×3.0cm大小，质地中等，扪诊呈结节状，高起处常较软，与皮肤无粘连。如该肿物近期生长加速，并伴有疼痛、面神经麻痹等症状时，则应考虑
A. 多形性腺瘤恶变
B. 皮脂腺癌
C. 皮样囊肿恶变
D. 继发腮腺区淋巴结炎
E. 转移癌

正确答案：A。多形性腺瘤恶变

解析：当多形性腺瘤在缓慢生长一段时期以后，突然出现生长加速，并伴有疼痛、面神经麻痹等症状时，应考虑恶变。但有的肿瘤生长速度快慢不等，可突然生长加快。因此，不能单纯根据生长速度来判断有无恶变，应结合其他表现综合考虑。掌握“多形性腺瘤”知识点。